患牙咬合面有深的龋洞，平时没有疼痛，有食物嵌入后剧烈疼痛。探诊可探及穿髓孔引起剧烈的疼痛，叩诊患牙有不适感，表明
A. 牙髓正常
B. 牙髓坏死
C. 可复性牙髓炎
D. 牙髓钙化
E. 慢性牙髓炎

正确答案：E。慢性牙髓炎

解析：慢性牙髓炎的诊断要点有：①可以定位患牙，有长期冷、热刺激痛病史和（或）自发痛史。②可查到引起牙髓炎的牙体硬组织疾患或其他病因。③患牙对温度测验的异常表现。④叩诊反应可作为很重要的参考指标。掌握“可复性、急慢性牙髓炎”知识点。